药物经济研究中，直接成本包括
A. 药品费
B. 护理费
C. 检验费
D. 精神损失费
E. 误工费

正确答案：A、B、C。药品费；护理费；检验费

解析：本题考查药物经济研究。在药物经济学研究中，成本包括直接成本及间接成本两部分。前者指与医疗及药品有关的直接成本，包括药品费（A对）、护理费（B对）、检验费（C对）；而后者并不涉及现金经济业务，只包括因病误工或死亡造成的收入损失及家庭成员陪护工资的损失（E错）等。